《痹论》“夜卧则惊，多饮数小便，上为饮如怀”是
A. 脾痹的症状
B. 肝痹的症状
C. 心痹的症状
D. 肺痹的症状
E. 肾痹的症状

正确答案：B。肝痹的症状

解析：肝痹者，夜卧则惊，多饮数小便，上为引如怀（B对）。脾痹者，四支懈惰，发咳呕汁，上为大塞（A错）；心痹者，脉不通，烦则心下鼓，暴上气而喘，嗌干善噫，厥气上则恐（C错）；肺痹者，烦满喘而呕（D错）；肾痹者，善胀，尻以代踵，脊以代头（E错）。